男性，31岁，有胃溃疡穿孔手术史，3天前出现腹胀、腹痛伴呕吐，肛门停止排便、排气，经检查诊断为肠梗阻，现最为重要的是了解梗阻的
A. 原因
B. 部位
C. 程度
D. 发生速度
E. 是否绞窄

正确答案：E。是否绞窄

解析：青年男性患者，3天前出现腹胀、腹痛伴呕吐、肛门停止排便排气，诊断为肠梗阻。由于绞窄性肠梗阻病情较重，进展迅速，需及时手术解除梗阻，恢复肠管血液循环。因此该患者现在最重要的是了解梗阻是否绞窄（E对）。梗阻的原因（A错）、部位（B错）、程度（C错）、发生速度（D错）等可作为选择治疗方法的依据，但不是最重要的。